半数有效量（ED₅₀）是
A. 引起50%动物死亡的剂量
B. 引起50%动物中毒的剂量
C. 引起50%动物产生阳性反应的剂量
D. 和50%受体结合的剂量
E. 达到50%有效血药浓度的剂量

正确答案：C。引起50%动物产生阳性反应的剂量